依据新分类方法，药品不良反应按不同反应的英文名称首字母分为A～H和U九类。其中A类不良反应是指
A. 促进微生物生长引起的不良反应
B. 家庭遗传缺陷引起的不良反应
C. 取决于药物或赋形剂的化学性质引起的不良反应
D. 特定给药方式引起的不良反应
E. 药物对人体呈剂量相关的不良反应

正确答案：E。药物对人体呈剂量相关的不良反应

解析：本题考查药品不良反应的分类。A类不良反应是指药物对人体呈剂量相关的反应（E对），它可根据药物或赋形剂的药理学和作用模式来预知，停药或减量可以部分或完全改善（与剂量相关，发生率高，死亡率低）。促进微生物生长引起的不良反应（A错）是B类反应。家庭遗传缺陷引起的不良反应（B错）是F类反应。取决于药物或赋形剂的化学性质引起的不良反应（C错）是C类反应。特定给药方式引起的不良反应（D错）是D类反应。